股骨干下1/3骨折损伤的结构是
A. 股静脉
B. 股神经
C. 股动脉
D. 大隐静脉
E. 腘动脉

正确答案：E。腘动脉

解析：股骨干下1/3骨折因其远端向后移位，易损伤腘动脉（E对）、腘静脉和胫神经、腓总神经。